下列哪项不属于孕产期保健健康指标
A. 孕产妇中重度贫血患病率
B. 孕产妇死亡率
C. 孕产妇系统管理率
D. 新生儿破伤风发病率
E. 低出生体重儿发生率

正确答案：C。孕产妇系统管理率

解析：本题考查孕产期保健健康指标。孕产妇系统管理率（C错，为本题正确答案）属于孕产期保健服务指标。孕产期保健健康指标包括：孕产妇中重度贫血患病率（A对）、孕产妇艾滋病病毒感染率、孕产妇梅毒感染率、孕产妇乙肝表面抗原阳性率、孕产妇死亡率（B对）、低出生体重儿发生率（E对）、围生儿死亡率、新生儿破伤风发病率（D对）、出生缺陷发生率等。